下列关于疥疮的叙述，正确的是
A. 传染性极强，夏季多见
B. 好发于头面部、头发和掌跖部
C. 皮损处有灰白色、浅黑色或普通皮色的隧道
D. 患者常有奇痒，遇冷会加重
E. 刮取皮损部位，不能找到疥螨或虫卵

正确答案：C。皮损处有灰白色、浅黑色或普通皮色的隧道

解析：疥疮传染性极强，冬春季多见（A错）。皮损好发于皮肤薄嫩和褶皱处，如手指侧、指缝、腕肘关节屈侧、腋窝前缘、女性乳房下、少腹、外阴、腹股沟、大腿内侧等处。头面部和头皮、掌跖一般不易累及（B错）。隧道为疥疮的特异性皮疹，长约0.5mm，弯曲，微隆起，呈淡灰色或皮色，在隧道末端有一个针头大的灰白色或微红的小点，为疥虫隐藏的地方（C对）。患者常有奇痒，遇热或夜间尤甚（D错）。刮取皮损部位，阳性标本可找到疥螨或虫卵（E错）。